男，27岁，脑外伤2小时，伤后2分钟清醒，清醒后立刻给家人打电话，但无法描述受伤原因。神经检查无阳性，头颅CT大致正常。诊断是
A. 脑挫裂伤
B. 脑震荡
C. 硬膜下血肿
D. 硬膜外血肿
E. 脑出血

正确答案：B。脑震荡

解析：患者男，27岁，脑外伤2小时（脑震荡因素），伤后2分钟清醒，清醒后立刻给家人打电话，但无法描述受伤原因。神经检查无阳性（脑震荡表现），头颅CT大致正常（脑震荡辅助检查表现），结合患者的因素，表现和辅助检查，诊断为脑震荡（B对）。意识障碍是脑挫裂伤最突出的症状之一。头痛、恶心、呕吐也是脑挫裂伤最常见的症状（（A错）。硬脑膜下血肿，CT检查可以确诊，急性或亚急性硬脑膜下血肿表现为脑表面与颅骨之间有新月形高密度、混杂密度或等密度影,多伴有脑挫裂伤、脑组织受压和中线移位（C错）。硬脑膜外血肿：进行性意识障碍为硬脑膜外血肿的主要症状，其变化过程与原发性脑损伤的轻重和血肿形成的速度密切相关。临床上常见三种情况：①原发脑损伤轻，伤后无原发昏迷，待血肿形成后出现意识障碍（清醒-昏迷）；②原发脑损伤略重，伤后一度昏迷，随后完全清醒或好转，但不久又陷入昏迷（昏迷-中间清醒或好转-昏迷）；③原发脑损伤较重，伤后昏迷进行性加重或持续昏迷（D错）。（P180）急性颅内压增高：见于急性颅脑损伤引起的颅内血肿、高血压性脑出血等（E错）。以上四种疾病的头颅CT表现与脑震荡的头颅CT结果不一样。